为保证儿童及时接受预防接种，医疗机构与儿童的监护人员应当
A. 订立合同
B. 共同协商
C. 付款监督
D. 由政府联系
E. 相互配合

正确答案：E。相互配合

解析：预防接种是为由多方组织和儿童监护人相互配合的、控制疾病传染，增强儿童免疫的措施。为保证儿童及时接受预防接种，医疗机构与儿童的监护人员应当相互配合（E对）。订立合同（A错）、共同协商（B错）、付款监督（C错）、由政府联系（D错）都只是这个相互配合过程中的一部分。